微血栓的主要成分是
A. 血小板
B. 白蛋白
C. 纤维素
D. 红细胞
E. 白细胞

正确答案：C。纤维素

解析：微血栓（透明血栓）的主要成分是纤维蛋白（C对）。血小板（A错）是白色血栓的主要成分。红细胞（D错）是混合血栓和红色血栓的主要成分。